患者，女，46岁。口渴，小便频数，下半身常有冷感，腰痛脚软，舌淡胖苔薄白，脉沉弦。治疗应选用
A. 清燥救肺汤
B. 麦门冬汤
C. 玉液汤
D. 肾气丸
E. 左归丸

正确答案：D。肾气丸

解析：患者口渴，小便频数，下半身常有冷感，腰痛脚软，舌淡胖苔薄白，脉沉弦。为肾阳不足证。腰为肾府，肾阳不足，故腰痛脚软、下半身常有冷感；肾阳亏虚亏虚不能蒸化水夜，水液直趋下焦，津不上乘，故口渴、小便频数。方用肾气丸。干地黄滋阴补肾；山茱山药补肝脾而益精血，泽泻、茯苓利水渗湿，桂枝温化痰饮，丹皮苦辛而寒，擅入血分（D对）。清燥救肺汤治温燥伤肺之重证（A错）。麦门冬汤所治虚热肺痿乃肺胃阴虚，气火上逆所致。为治疗肺胃阴虚，湿和气逆所致咳嗽或呕吐的常用方（B错）。玉液汤治消渴气阴两虚证证（C错）。左归丸方证因真阴不足，精髓亏损所致。为治疗真阴不足的常用方（E错）。